腹部闭合伤，确诊有无内脏伤最简便，最可靠的诊断方法为
A. X线照片
B. CT
C. 白细胞计数
D. B超
E. 腹腔穿刺

正确答案：E。腹腔穿刺

解析：腹部闭合伤，确诊有无内脏伤最简便、最可靠的诊断方法为腹腔穿刺（E对）。腹部闭合性损伤患者，诊断性腹腔穿刺检查的阳性率可达90％以上，对判断腹腔内脏有无损伤和哪一类脏器损伤有很大帮助。X线照片（A错）主要用于腹部空腔脏器破裂的诊断；CT（B错）、B超（D错）对实质性脏器损伤的诊断有重要价值；白细胞计数（C错）为一般常规检查，不能用于确诊腹部损伤。